硫脲类抗甲状腺药起效慢的原因是
A. 口服吸收缓慢
B. 肝内代谢转化慢
C. 肝内代谢转化快
D. 肾脏排泄速度快
E. 待已合成的的甲状腺素消耗完后才能起效

正确答案：E。待已合成的的甲状腺素消耗完后才能起效

解析：硫脲类并不抑制贮存在腺泡内的甲状腺激素的释放，也不能拮抗甲状腺激素的作用，故须待甲状腺内贮存的激素消耗到一定程度才能呈现疗效（E对）。